可用于检查的杂质为：在酸性溶液中与硫氰酸盐生成红色的方法
A. 氯化物
B. 砷盐
C. 铁盐
D. 硫酸盐
E. 重金属

正确答案：C。铁盐